肝阳上亢引起的头痛多见
A. 胀痛
B. 重痛
C. 刺痛
D. 灼痛
E. 隐痛

正确答案：A。胀痛

解析：本题考查胀痛的性质特点及临床意义。肝阳上亢引起的头痛多见是胀痛（A对）。胀痛：指疼痛伴有胀满或胀闷。多为气滞所致，在很多部位都可以出现，以胸脘、腹部为最多。如胃脘胀痛，则为中焦寒凝气滞；胸胁胀痛，则为肝郁气滞等。头部胀痛，则多见于肝阳上亢或肝火上炎的病证。重痛（B错）：指疼痛并伴有沉重的感觉，称为重痛。多见于头部、四肢及腰部，多因湿邪困遏气血所致。湿性重浊而黏腻，湿滞于经脉，则令人有沉重的感觉。如头沉而痛、四肢困重疼痛、腰重坠而痛者，均属湿证。刺痛（C错）：指疼痛有如针刺的感觉，称为刺痛。是瘀血疼痛的特点之一，以胸胁、少腹、小腹、胃脘部出现为多。灼痛（D错）：指痛有灼热感而喜凉的感觉，称为灼痛。常见于两肋或胃脘部。多由于火邪窜络，或阴虚阳热亢盛所致。隐痛（E错）：指疼痛并不剧烈，可以忍耐，却绵绵不休，持续时间较长的感觉，称为隐痛。一般多是气血不足，阴寒内生，气血运行滞涩而成。多见于头、脘、腹、腰部的虚性疼痛。